男性，25岁。因高位小肠瘘1天入院，入院后经颈内静脉插管滴入肠外营养液，两周后突然出现寒战、高热，无咳嗽、咳痰，腹部无压痛和反跳痛。如果24小时后发热仍不退，应采取
A. 用抗生素
B. 胸腔穿刺抽气
C. 停止肠外营养
D. 气管切开
E. 增加胰岛素用量

正确答案：A。用抗生素

解析：患者因肠瘘而行肠外营养，后出现寒战、高热等全身感染症状，而无咳嗽、咳痰，故其最有可能的诊断为导管性脓毒症。导管性脓毒症的治疗最主要的是拔除中心静脉导管，若消除感染根源之后发热仍不退，则需应用抗生素（A对）控制感染进一步蔓延。胸腔穿刺抽气（B错）是气胸的治疗措施。停止肠外营养（C错）是患者早期已采取的治疗措施（需注意，此题为病例题，进一步治疗是在前两题的基础上进行的）。气管切开（D错）主要用于出现急性呼吸困难的患者。增加胰岛素用量（E错）只能降低血糖，不能有效改善患者的全身感染症状。